液体滤过符合Poiseuille公式的，关于滤速与滤过效率的关系，说法正确的是
A. 操作压力越大，滤过速度越慢
B. 滤液黏度越大，滤过速度越快
C. 毛细管越细，滤过速度越快
D. 滤过容量与时间成反比
E. 滤层厚度与滤速成反比

正确答案：E。滤层厚度与滤速成反比

解析：本题考查Poiseuille公式。液体滤过符合Poiseuille公式的，关于滤速与滤过效率的关系，说法正确的是滤层厚度与滤速成反比（E对）。根据Poiseuille公式v=Pπr⁴/（8ηL）可知，滤过效率与滤液黏度（B错）和滤层厚度成反比，与操作压力、毛细管半径及滤过时间成正比（ACD错）。